有些人在工作中认真负责，有些人敷衍了事，有些人得过且过。这些表现在人的性格特征中属于
A. 态度特征
B. 理智特征
C. 认知特征
D. 情绪特征
E. 意志特征

正确答案：A。态度特征

解析：性格的结构可以分为四个维度的特征，分别是态度特征、意志特征、理智特征、情绪特征。态度特征（A对）是指个体在对现实生活各个方面的态度中表现出来的一般特征。题中工作态度的不同反应属于态度特征。理智特征（B错）是指个体在认知活动中表现出来的心理特征。情绪特征（D错）是指个体在情绪表现方面的心理特征。意志特征（E错）是指个体在调节自己的心理活动时表现出的心理特征。